舌根部有许多卵圆形滤泡样突起，称为
A. 舌根滤泡
B. 舌根乳头
C. 舌根淋巴结
D. 舌扁桃体
E. 腭扁桃体

正确答案：D。舌扁桃体

解析：本题考查舌背表面标志。舌根部有许多卵圆形滤泡样突起，称为舌扁桃体（D对）。舌根滤泡，可能为舌根部淋巴滤泡增生，系咽黏膜的慢性炎症，常为呼吸道慢性炎症的一部分（A错）。舌后1/3因参与咽囊壁的构成，又称为舌的咽部即舌根。舌后1/3黏膜无乳头（B错），有许多结节状淋巴结组织，呈卵圆形滤泡状突起，称为舌扁桃体，这些卵圆形滤泡样突起的舌扁桃体是淋巴结组织形成的。舌根淋巴结一般无此提法（C错）。腭扁桃体是淋巴组织与上皮紧密联结构成的淋巴上皮器官，位于腭舌弓与腭咽弓间的扁桃体窝内，即通常所说的扁桃体（E错）。